饮片切面棕黄色至金黄色，角质样，有蜡样光泽，有明显内皮层环纹及散在的点状维管束；气特异，味苦而辛的是
A. 百部
B. 石菖蒲
C. 知母
D. 莪术
E. 姜黄

正确答案：E。姜黄

解析：本题考查的是姜黄饮片的性状鉴别。饮片切面棕黄色至金黄色，角质样，有蜡样光泽，有明显内皮层环纹及散在的点状维管束；气特异，味苦而辛的是姜黄（E对）。姜黄：【性状鉴别】饮片呈类圆形或不规则形厚片。外表皮深黄色，有时可见环节，切面棕黄色或金黄色，角质样，内皮层环纹明显，维管束点状散在。气香特异，味苦、辛。百部（A错）：【性状鉴别】饮片呈不规则厚片或不规则的条形斜片。表面灰白色、棕黄色，有深纵皱纹。切面灰白色、淡黄棕色或黄白色，角质样；皮部较厚，中柱扁缩。质韧软。气微，味甘、苦。石菖蒲（B错）：【性状鉴别】饮片呈扁圆形或长条形厚片。外表皮棕褐色或灰棕色，有的可见环节及根痕，切面纤维性，类白色或微红色，有明显环纹及油点。气芳香，味苦、微辛。知母（C错）：【性状鉴别】饮片呈不规则类圆形的厚片。外表皮黄棕色或棕色，可见少量残存的黄棕色叶基纤维或凹陷或突起的点状根痕。切面黄白色至黄色。气微，味微甜、略苦，嚼之带黏性。莪术（D错）：【性状鉴别】饮片呈类圆形或椭圆形厚片。外表皮灰黄色或灰棕色，有时可见环节或须根痕，切面黄绿色、黄棕色或棕褐色，内皮层环纹明显，散在“筋脉”小点。气微香，味微苦而辛。